关于中药浸提的说法错误的是
A. 浸渍法适用于黏性中药的浸提
B. 浸渍法适用于易膨胀中药的浸提
C. 浸渍法不适于贵重中药的浸提
D. 渗漉法适用于毒性中药的浸提
E. 渗漉法适用于无组织结构中药的浸提

正确答案：E。渗漉法适用于无组织结构中药的浸提

解析：本题考查的是中药化学成分的提取方法。关于中药浸提的说法错误的是渗漉法适用于无组织结构中药的浸提（E错，为本题正确答案）。渗漉法是不断向粉碎的中药材中添加新鲜浸出溶剂，使其渗过药材，从渗漉筒下端出口流出浸出液的一种方法。适用于贵重药材（C对）、毒性药材（D对）及高浓度制剂；也可用于有效成分含量较低的药材提取。浸渍法是在常温或温热（60℃～80℃）条件下用适当的溶剂浸渍药材以溶出其中有效成分的方法。本法适用于有效成分遇热不稳定的或含大量淀粉、树胶、果胶、黏液质（A对）的中药的提取。但本法出膏率低，需要特别注意的是当水为溶剂时，其提取液易于发霉变质，需注意加入适当的防腐剂。